描述局部地区或集体单位中，短时间内突然发生很多症状相同的患者的最适合用语可为
A. 暴发
B. 散发
C. 流行
D. 大流行
E. 暴发性流行

正确答案：A。暴发